皂苷元的结构类型有
A. 齐墩果烷型
B. 倍半萜烷型
C. 螺旋甾烷型
D. 异螺旋甾烷型
E. 萜烷型

正确答案：A、C、D。齐墩果烷型；螺旋甾烷型；异螺旋甾烷型

解析：本题考查的是皂苷元的结构类型。皂苷元的结构类型有齐墩果烷型（A对）、螺旋甾烷型（C对）、异螺旋甾烷型（D对）。四环三萜皂苷元主要有羊毛甾烷型、达玛烷型。五环三萜主要类型包括齐墩果烷型、乌苏烷型和羽扇豆烷型等。甾体皂苷分类主要有螺旋甾烷醇类、异螺旋甾烷醇类、呋甾烷醇类和变形螺旋甾烷醇类等。